患者胸胁支满，心下痞闷，胃中有振水音，脘腹喜温畏冷，背寒，呕吐清水痰涎，水入易吐，口渴不欲饮，心悸，气短，头昏目眩，食少，形体逐渐消瘦，舌苔白滑，脉弦细而滑。其治法是
A. 宣肺化饮
B. 淡渗利水
C. 温脾化饮
D. 温化寒湿
E. 逐水化饮

正确答案：C。温脾化饮

解析：根据“胸胁支满，心下痞闷，胃中有振水音”可知病为“痰饮”；根据“脘腹喜温畏冷，背寒，呕吐清水痰涎，水入易吐，口渴不欲饮，心悸，气短，头昏目眩，食少，形体逐渐消瘦，舌苔白滑，脉弦细而滑”可辨为“脾阳虚弱证”，治疗应温脾化饮（C对）。宣肺化饮为支饮之寒饮伏肺证的治法（A错）。温化寒湿为黄疸之阴黄的治法（D错）。逐水化饮为痰饮之饮留胃肠证的治法（E错）。